两侧骼嵴最高点连线中点平
A. 第1腰椎棘突
B. 第2腰椎棘突
C. 第3腰椎棘突
D. 第4腰椎棘突
E. 第5腰椎棘突

正确答案：D。第4腰椎棘突

解析：两侧髂嵴最高点连线平对第4腰椎棘突（D对），是计数椎骨标志。